氟斑牙主要的损伤部位为
A. 牙釉质
B. 牙本质
C. 牙龈
D. 牙槽
E. 以上都不是

正确答案：A。牙釉质

解析：本题考查氟斑牙主要的损伤部位。氟斑牙是由于牙釉质在发育期摄入了过多的氟导致的牙体组织疾病。其主要的损伤部位为牙釉质（A对BCDE错）。轻者缺损仅限于釉质表层，严重者缺损可发生在所有的牙面，包括邻接面，以致破坏了牙齿整体外形。